下列哪项不属于睾丸肿瘤分型
A. 精原细胞瘤
B. 畸胎瘤
C. 卵黄囊肿瘤
D. 胚胎癌
E. 乳头状癌

正确答案：E。乳头状癌

解析：睾丸肿瘤较少见，但却是青壮年男性常见的实体肿瘤，几乎都属于恶性。睾丸肿瘤分为原发性和继发性两大类，其中，原发性又分为生殖细胞肿瘤和非生殖细胞肿瘤。生殖细胞肿瘤可分为精原细胞瘤（A对）、畸胎瘤（B对）、卵黄囊瘤（C对）、绒毛膜癌和胚胎癌（D对）等5种基本类型；非生殖细胞肿瘤分为间质细胞瘤、支持细胞瘤等。继发性睾丸肿瘤主要来自淋巴瘤及白血病等转移性肿瘤。乳头状癌（E错，为本题正确答案）不属于睾丸肿瘤分型。